患者男性，63岁，颊癌术后7年，术后曾行颈部及颌下区放疗，剂量不详。3个月前行出现下颌牙龈溃疡，经久未愈且局部骨外露伴下颌区域针刺剧痛。此患者可能的诊断为
A. 下颌牙龈癌
B. 放射性颌骨坏死
C. 中央性颅骨骨髓炎
D. 边缘性颌骨骨髓炎
E. 原发性三叉神经痛

正确答案：B。放射性颌骨坏死

解析：本题考查放射性颌骨坏死。患者男性，63岁，颊癌术后7年，术后曾行颈部及颌下区放疗，剂量不详。3个月前行出现下颌牙龈溃疡，经久未愈且局部骨外露伴下颌区域针刺剧痛。此患者可能的诊断为放射性颌骨坏死（B对）。放射性颌骨坏死患者有放疗史，往往数月仍至十余年才出现症状，发病初期呈持续性针刺样痛，黏膜或皮肤破溃，牙槽突、颌骨骨面外露呈黑褐色。中央性颌骨骨髓炎（C错）慢性期X线可见大块死骨形成，周围骨质分界清楚或伴病理性骨折；边缘性颌骨骨髓炎（D错）慢性期X线可见骨皮质疏松脱钙或骨质增生硬化，或有小死骨块，与周围骨质无明显分界。三叉神经痛（E错）又称“痛性痉挛”，是指在三叉神经分布区域内出现阵发性、针刺样、电击样剧烈疼痛，历时数秒至数分钟，疼痛呈周期性发作，间歇期无症状。任何刺激口腔颌面部的扳机点可引起疼痛。原发性三叉神经痛系指无神经系统体征，如三叉神经分布区的感觉、运动正常，而且应用各种检查并未发现明显与发病有关的器质性病变。